下述病原体中最易引起脓血便的是
A. 轮状病毒
B. 隐孢子虫
C. 鼠伤寒沙门菌
D. 产毒性大肠埃希菌
E. 致病性大肠埃希菌

正确答案：C。鼠伤寒沙门菌

解析：轮状病毒（P259）（A错）引起的腹泻表现为水样腹泻。隐孢子虫（B错）引起的腹泻表现为水样或糊状，一般无脓血。鼠伤寒沙门菌（P119）（C对）引起的腹泻表现为水样腹泻，偶有黏液或脓性腹泻。产毒性大肠埃希菌（P110）（D错）引起的腹泻表现为水样腹泻。致病性大肠埃希菌（P112）（E错）引起的腹泻表现为严重水样腹泻。按八版教材观点，此题无正确答案。